左旋多巴与卡比多巴联合用于治疗
A. 失眠
B. 抑郁症
C. 帕金森病
D. 阿尔茨海默病
E. 精神分裂症

正确答案：C。帕金森病

解析：本题考查帕金森病用药。卡比多巴单用无明显药理作用，与左旋多巴合用治疗各种原因引起的帕金森病（C对）。失眠（A错）可用镇静催眠药如苯二氮卓类。抑郁症（B错）可用抗抑郁药如单胺氧化酶抑制剂。阿尔茨海默病（AD）（D错）是一种起病隐匿的进行性发展的神经系统退行性疾病。精神分裂症（E错）可用抗精神分裂药如氯丙嗪。